与腭骨水平部共同构成腭大孔的是
A. 额突
B. 颧突
C. 腭突
D. 喙突
E. 上颌牙槽突

正确答案：E。上颌牙槽突

解析：牙槽突（牙槽骨）两侧上颌牙槽突在中线相接，形成牙槽骨弓，上颌牙槽突与腭骨水平部共同构成腭大孔，有腭前神经通过。掌握“上颌骨解剖特点”知识点。